支气管扩张，常表现为
A. 指关节梭状畸形
B. 杵状指
C. 匙状甲
D. 浮髌现象
E. 肢端肥大

正确答案：B。杵状指

解析：支气管扩张，常表现为杵状指（B对），即手指或足趾末端增生、肥厚、增宽、增厚，指甲从根部到末端拱形隆起呈杵状，杵状指还可见于慢性肺脓肿、支气管肺癌、发绀型先天性心脏病、亚急性感染性心内膜炎、肝硬化等。指关节梭状畸形（A错）见于类风湿性关节小。匙状甲（C错）又称反甲，常见于缺铁性贫血和高原疾病，偶见于风湿热及甲癣。浮髌现象阳性（D错）提示中等量以上关节积液（50ml）。肢端肥大（E错）是因生长激素分泌过多所致，见于巨人症。